阿托品抑制腺体分泌最敏感的是
A. 胃液分泌
B. 泪腺分泌
C. 呼吸道腺体分泌
D. 唾液腺和汗腺分泌
E. 胃酸分泌

正确答案：D。唾液腺和汗腺分泌